有关食物嵌塞的描述错误的是
A. 食物嵌塞分为垂直型和水平型
B. 水平型食物嵌塞可有牙龈乳头的退缩
C. 垂直型食物嵌塞时患者不能指出牙位
D. 垂直型食物嵌塞时可见邻间隙内嵌有纤维性食渣
E. 咀嚼过程中，因咬合压力使食物碎块嵌入相邻牙间隙内

正确答案：C。垂直型食物嵌塞时患者不能指出牙位

解析：垂直型食物嵌塞时，患者能指出牙位。掌握“牙周疾病检查”知识点。